使用化妆品后24h出现面部水肿渗出痒痛，应属于
A. Ⅰ型变态反应
B. Ⅱ型变态反应
C. Ⅲ型变态反应
D. Ⅳ型变态反应
E. 以上都不是

正确答案：D。Ⅳ型变态反应

解析：使用化妆品后24h出现面部水肿、渗出、痒痛反应是一种接触性迟发型超敏反应，是由于化妆品中小分子的半抗原与体内蛋白质结合成全抗原，经朗格汉斯细胞摄取并提呈给T细胞，使其活化、分化为效应T细胞和记忆T细胞，机体再次接触相应抗原后刺激特异性T细胞活化，产生一系列细胞因子，介导组织炎症损伤，局部皮肤出现水肿等反应，此反应属于Ⅳ型超敏反应（D对E错）。Ⅰ型超敏反应（A错）（P146）在四型超敏反应中发生速度与最快，一般在第二次接触抗原后数分钟内出现临床症状，故也称速发型超敏反应。变应原是Ⅰ型超敏反的始动因素，肥大细胞和嗜碱性粒细胞表面表达高亲和性IgE Fc受体介导Ⅰ型超敏反发生，常见的疾病是药物过敏性休克，支气管哮喘等。Ⅱ型超敏反应（B错）（P150）又称为细胞型或细胞毒型超敏反应，是由IgG或IgM抗体与靶细胞表面相应抗原结合后，在补体、吞噬细胞和NK细胞参与下，引起的以细胞溶解或组织损伤为主的病理免疫反应。与Ⅱ型超敏反应有关的疾病有输血反应、新生儿溶血病、自身免疫溶血性贫血、药物过敏性血细胞减少症等。Ⅲ型超敏反应（C错）（P151）是由可溶性免疫复合物沉积于局部或全身多处毛细血管基底膜后，通过激活补体，并在中性粒细胞、血小板、嗜碱性粒细胞等效应细胞参与下，引起的以充血水肿、局部坏死和中性粒细胞浸润为主要特征的炎症反应和组织损伤，临床常见的Ⅲ型超敏反应性疾病有局部免疫复合物病（arthus反应和类arthus反应）和全身性免疫复合物病（血清病、链球菌感染后肾小球肾炎和类风湿性关节炎）。